下列哪些形式不属于基因突变
A. 颠换
B. 倒位
C. 移码突变
D. 大段损伤

正确答案：B。倒位

解析：本题考查基因突变的类型。基因突变是指基因中DNA碱基序列的变化，其类型包括：1.碱基置换：包括转换和颠换（A对）两种情况；2.移码突变（C对）；3.密码子插入或缺失（D对）。倒位（B错，为本题正确答案）属于染色体型畸变的类型。